体内两条电子传递链分别以不同递氢体起始，经呼吸链最后将电子传递给氧，生成水。这两条电子传递链的交叉点是
A. CytB
B. FAD
C. FMN
D. CytC
E. CoQ

正确答案：E。CoQ